环境质量指数是一种
A. 无量纲的指标体系
B. 分级的评价体系
C. 由若干个评价参数组成的评价标准
D. 权重的综合评价指数
E. 综合评价环境质量的无量纲数值

正确答案：E。综合评价环境质量的无量纲数值

解析：本题考查环境质量指数。环境质量指数是将大量监测数据经统计处理后求得其代表值，以环境卫生标准（或环境质量标准）作为评价标准，把它们代入专门设计的计算式，换算成定量和客观地评价环境质量的无量纲数值（E对ABCD错）。